女，68岁。反复咳嗽、咳痰20年，气喘10年，加重伴下肢水肿一周入院。高血压病史10余年，145/90mmHg。查体：T37.8℃，口唇发绀，血压135/80mmHg，双下肺散在湿啰音和哮鸣音，肝肋下3厘米，肝颈静脉回流征阳性，双下肢水肿。WBC9.3×10⁹/L，N0.78。该患者发生下肢水肿的机制是
A. 水钠潴留
B. 淋巴回流障碍
C. 体循环淤血
D. 毛细血管通透性增加
E. 继发性醛固酮增多

正确答案：C。体循环淤血

解析：本例患者长期咳嗽咳痰，伴有气喘症状，出现口唇发绀，双肺湿啰音和哮鸣音（呼吸衰竭的表现），肝颈静脉回流征阳性，下肢水肿等体征（右心衰竭的表现），患者首选诊断为慢性肺源性心脏病（P110-P111）。右心衰竭（九版生理学P127）时，体循环淤血（C对），静脉回流受阻，使全身毛细血管后阻力增大，导致毛细血管有效流体静压增高，引起下肢水肿。淋巴回流障碍（B错）一般见于非特异性淋巴管炎、丝虫病、淋巴结切除后等情况（九版诊断学P16）。水钠潴留（A错）是肾病性水肿的主要病理生理改变，部分患者可因有效血容量减少，刺激肾素-血管紧张素-醛固酮而导致继发性醛固酮增多（E错），进一步加重水钠潴留（P465）。毛细血管通透性增加（九版生理学P127）（D错）引起的水肿常见于感染、烧伤、过敏等情况。